颅脑外伤引起的脑水肿宜选用的药物是
A. 呋塞米
B. 氨苯蝶啶
C. 螺内酯
D. 氢氯噻嗪
E. 甘露醇

正确答案：E。甘露醇

解析：甘露醇是目前降低颅内压安全有效的首选药。适用于多种原因如脑瘤、颅脑外伤或组织缺氧等引起的脑水肿，以及青光眼病人手术前降低眼内压（E对）。呋塞米临床应用：严重水肿，急性脑水肿及肺水肿，及慢性肾衰竭，排除毒物。（A错）氨苯蝶啶临床应用：与其他利尿药合用于顽固性水肿（B错）。螺内酯临床应用：高醛固酮型水肿，原发性醛固酮增多症，充血性心衰（C错）。氢氯噻嗪临床应用：各型轻、中度水肿，高血压，轻度尿崩症（D错）。